慢性汞中毒的三大特征性临床表现是
A. 口腔炎、发热、皮疹
B. 易兴奋、震颤、口腔炎
C. 周围神经炎、腹痛、贫血
D. 口腔炎、腹痛、肾功能障碍
E. 贫血、易兴奋、皮疹

正确答案：B。易兴奋、震颤、口腔炎

解析：本题考查慢性汞中毒的特征性临床表现。慢性汞中毒较常见，其典型临床表现为易兴奋症、震颤和口腔炎（B对ACDE错）。①神经系统：初期表现为类神经症，震颤是神经毒性的早期症状；②口腔，多发牙龈炎；③少数病人有肾脏损害。